尺神经支配
A. 指浅屈肌尺侧半
B. 全部蚓状肌
C. 全部骨间肌
D. 大小鱼际肌
E. 尺侧腕伸肌

正确答案：C。全部骨间肌

解析：指浅屈肌尺侧半（A错）由正中神经支配。第1、2蚓状肌由正中神经支配，第3、4蚓状肌由尺神经支配（B错）。尺神经支配全部骨间肌（C对）、小鱼际肌（D错）及尺侧腕屈肌（E错）。